唾液腺的叙述，不正确的是
A. 包括腮腺、下颌下腺和舌下腺
B. 腮腺导管开口于平对上颌第2磨牙所对的颊黏膜处
C. 下颌下腺导管开口于舌系带根部两侧的舌下阜
D. 舌下腺大管直接开口于舌下襞
E. 腮腺的分泌受舌咽神经控制，而下颌下腺及舌下腺的分泌则由面神经控制

正确答案：D。舌下腺大管直接开口于舌下襞

解析：唾液腺包括腮腺、下颌下腺和舌下腺(A对)，腮腺导管开口于平对上颌第2磨牙牙冠所对的颊粘膜(B对)，下颌下腺导管(C对)和舌下腺大管(D错，为本题正确答案)均开口于舌下阜，腮腺分泌由舌咽神经控制，下颌下腺以及舌下腺的分泌由面神经控制(E对)。